黄芩具有而黄柏不具有的功效是
A. 燥湿
B. 泻火
C. 解毒
D. 清肺热
E. 退虚热

正确答案：D。清肺热

解析：该题考查的是黄芩与黄柏的功效以及应用鉴别，属记忆内容。黄芩功效 清热燥湿，泻火解毒，止血，安胎。黄柏的功效清热燥湿，泻火解毒，除骨蒸（D对）。